关于逆行性牙髓炎的治疗措施叙述错误的是
A. 患牙如能保留，先去髓，再根管治疗
B. 牙髓治疗的同时进行牙周系统治疗
C. 必要时考虑将患根截除，保留患牙
D. 如治疗预后差，则可直接拔除患牙止疼
E. 不必考虑牙周手术，如分根术、截根术等

正确答案：E。不必考虑牙周手术，如分根术、截根术等

解析：逆行性牙髓炎治疗原则：根据患牙牙周病变的程度和牙周治疗的预后来决定是否保留患牙。患牙如能保留，先摘除全部牙髓，消除急性症状，再行根管治疗。同时进行牙周系统治疗。必要时考虑将患根截除，保留患牙。如牙周病变严重，治疗预后差，则可直接拔除患牙止疼。掌握“残髓炎及逆行性牙髓炎”知识点。